下列哪项不是引起代谢性酸中毒合并呼吸性碱中毒的原因？
A. 感染性休克
B. 肺性脑病
C. 水杨酸中毒
D. 糖尿病合并感染
E. 心肺疾病伴有发热

正确答案：B。肺性脑病

解析：代谢性酸中毒合并呼吸性碱中毒常见的原因有感染性休克（A对）、水杨酸中毒（C对）、糖尿病合并感染（D对）、心肺疾病伴有发热（E对）、慢性肝病、高血氨并发肾衰竭等，肺性脑病（B错，为本题正确答案）是由于CO2浓度过高抑制呼吸中枢导致，是呼吸性酸中毒的表现。